属于β-内酰胺类抗生素的药物有
A. 青霉素
B. 红霉素
C. 亚胺培南
D. 头孢拉定
E. 庆大霉素

正确答案：A、C、D。青霉素；亚胺培南；头孢拉定

解析：本题考查β-内酰胺类抗菌药物。青霉素（A对）、头孢拉定（D对）、亚胺培南（C对）为β-内酰胺类抗菌药。红霉素（B错）为大环内酯类抗生素。庆大霉素（E错）属于氨基糖苷类抗生素。